女孩，9个月。秋季发病，腹泻轻咳2天入院，大便10次/日，蛋花汤样，大便镜检：白细胞2～3个/HP，大便细菌培养阴性，血常规：WBC为7.5×10⁹/L，除轻度脱水征外，无其它异常
A. 轮状病毒肠炎
B. 细菌性痢疾
C. 金葡菌肠炎
D. 真菌性肠炎
E. 致病性大肠杆菌肠炎

正确答案：A。轮状病毒肠炎

解析：9个月女童（轮状病毒高发年龄为6～12个月），秋季发病（秋冬季多见），因腹泻轻咳（上呼吸道感染症状）2天入院（潜伏期为24～48小时），大便10次/日，蛋花汤样（轮状病毒感染时典型粪便），有轻度脱水（常并发脱水），大便镜检可见白细胞2～3个/HP（少量白细胞），大便细菌培养阴性，血常规血白细胞为7.5×10⁹/L（排除细菌感染），最可能的诊断为轮状病毒肠炎（A对）。轮状病毒肠炎的病原体是A组轮状病毒，为婴儿腹泻最常见的原因。细菌性痢疾（B错）是由痢疾杆菌（志贺菌）引起的，急性细菌性痢疾经过1～3天的潜伏期后，突然发病，常有发热，腹痛和水样腹泻约1天，并由水样腹泻转变为脓血粘液便，伴有里急后重，若治疗不彻底，反复发作迁延不愈，病程超过2个月以上则属慢性（P115）。金葡菌肠炎（C错）为产毒菌株污染牛奶、肉类等食物，产生大量毒素，肠毒素作用于人体，刺激呕吐中枢导致以呕吐为主要症状的急性胃肠炎（食物中毒）（P94），一般不伴有发热。致病性大肠杆菌胃肠炎（E错）是由致病性大肠埃希菌（EPEC）引起的，是婴幼儿腹泻的主要病原菌，严重者致死，常见症状为发热、恶心、呕吐、水样便，大便镜检常有大量白细胞及数量不等的红细胞，粪便培养可找到大肠埃希菌（P111）。真菌性肠炎（D错）是严重肝肾疾病、恶性肿瘤等导致机体免疫功能降低，或继发于消化道某些疾病如痢疾、肠梗阻、食道脓肿等的疾病，多为条件致病真菌感染，八版医学微生物未明确说明。